老年人心理发展中的常见问题
A. 对死亡的恐惧
B. 老年人的性生活
C. 不适应离退休生活
D. 主观健康水平评价差
E. 以上说法均正确

正确答案：E。以上说法均正确

解析：本题考查不同年龄阶段心理卫生。老年人心理发展中的常见问题：①不适应离退休生活（C对）；②主观健康水平评价差（D对）；③老年人的性生活（B对）；④对死亡的恐惧（A对）。因此选E。